干扰素抑制病毒作用机制
A. 间接活化一种核酸内切酶促使RNA降解
B. 直接活化一种核酸内切酶促使RNA降解
C. 间接活化一种核酸外切酶促使mRNA降解
D. 直接活化一种核酸内切酶促使mRNA降解
E. 间接活化一种核酸内切酶促使mRNA降解

正确答案：E。间接活化一种核酸内切酶促使mRNA降解

解析：干扰素抑制病毒繁殖的作用机制有两种：一是干扰素能诱导细胞内一种特异的蛋白激酶活化，该活化的蛋白激酶使eIF-2磷酸化而失活，从而抑制病毒蛋白质合成；二是干扰素能与双链RNA共同活化特殊的2′-5′寡聚腺苷酸（2′-5′A）合成酶，生成核苷酸间以2′-5′磷酸二酯键连接的2′-5′A多聚物，经2′-5′A活化核酸酶RNase L，后者可降解病毒mRNA，即间接活化一种核酸内切酶促使mRNA降解（E对），从而阻断病毒蛋白质的合成。